机械结合力约占金-瓷结合力的
A. 0.6
B. 0.49
C. 0.26
D. 0.22
E. 0.03

正确答案：D。0.22

解析：机械结合力约占金-瓷结合力的22%。掌握“修复材料、金瓷结合及树脂粘结机制”知识点。